左旋多巴对抗精神病药引起的帕金森综合征无效的原因是
A. 抗精神病药阻断中枢DA受体
B. 抗精神病药抑制中枢DA的合成
C. 抗精神病药引起中枢DA受体下调
D. 抗精神病药促进中枢DA的分解
E. 抗精神病药抑制左旋多巴进入中枢

正确答案：A。抗精神病药阻断中枢DA受体